某企业生产的保持乙方检验报告的部分项目如下：其中，检验数据结果符合标准规定的项目有
A. 薄层色谱
B. 水分
C. 溶脂时限
D. 含量测定
E. 微生物限度

正确答案：A、B、C、D、E。薄层色谱；水分；溶脂时限；含量测定；微生物限度

解析：本题考查的是检验数据标准规定。某企业生产的保持乙方检验报告的部分项目如下：其中，检验数据结果符合标准规定的项目有薄层色谱（A对）、水分（B对）、溶脂时限（C对）、含量测定（D对）、微生物限度（E对）。